脑出血引起的发热主要是因为
A. 植物神经功能紊乱
B. 体温调节中枢的功能失常
C. 无菌性坏死物质的吸收
D. 皮肤散热量的减少
E. 感染性发热

正确答案：B。体温调节中枢的功能失常

解析：临床上通常把体温超过正常范围0.5°C者，都称为发热。引起发热的病因很多，按有无病原体侵入人体分为感染性发热（是各种病原体侵入人体所致，常见的病原体有细菌、病毒、立克次体、支原体、螺旋体、真菌、寄生虫等）（E错）和非感染性发热两大类。临床上感染性发热最常见。非感染性发热中，体温调节中枢功能失调是指致热因素直接损害体温调节中枢，如物理性因素（中暑等）、化学性因素（重度安眠药中毒等）、机械性因素（颅内占位性病变、脑出血等（B对），使体温调节中枢功能失常而引起发热，称为中枢性发热，高热而无汗是这类发热的特点。植物神经功能紊乱（A错）（是一种内脏功能失调的综合征。包括循环系统功能、消化系统功能或性功能失调的症状，多由心理社会因素诱发人体部分生理功能暂时性失调，神经内分泌功能出现相关改变而组织结构上并无相应病理改变的综合征）、无菌性坏死物质的吸收（C错）、皮肤散热量的减少（D错）都属于非感染性发热的因素。